有充分证据反对的药物信息属于
A. EBDIA类
B. EBDIB类
C. EBDIC类
D. EBDID类
E. EBDIE类

正确答案：E。EBDIE类